奋乃静的含量测定
A. 原料药采用非水溶液滴定法，片剂采用紫外分光光度法
B. 原料药采用紫外分光光度法，片剂采用非水溶液滴定法
C. 原料药采用非水溶液滴定法，片剂采用荧光分析法
D. 原料药采用紫外分光光度法，片剂采用高效液相色谱法
E. 原料药和片剂均采用高效液相色谱法

正确答案：A。原料药采用非水溶液滴定法，片剂采用紫外分光光度法